患者，女，24岁。进餐时突然倒地，意识丧失，四肢抽搐，双目上翻，牙关紧闭，口吐白沫，小便失禁，约20分钟后，抽搐停止，神识清醒，自觉肢体痠痛。头颅CT，血液生化检查均正常。自幼有类似发病，其诊断是
A. 癔病性抽搐
B. 低血钙性抽搐
C. 脑寄生虫病
D. 癫痫大发作
E. 昏厥性抽搐

正确答案：D。癫痫大发作

解析：癫痫大发作以意识丧失和全身对称性抽搐为特征，强直期表现为突然意识丧失，跌倒在地，全身肌肉强直性收缩，喉部痉挛，发出叫声。阵挛期表现为震颤幅度增大，并延及全身称为间歇性痉挛。惊厥后期表现为呼吸首先回复，心率、血压、瞳孔等恢复正常，肌张力松弛，意识恢复。故本病例可诊断为癫痫大发作（D对）。癔病性抽搐（A错）在情绪激动或受暗示下突然发作，常伴有呻吟、哭泣等精神症状。低血钙性抽搐（B错）无意识改变，仅表现为全身骨骼肌及平滑肌痉挛。脑寄生虫病（C错）有的表现像颅内占位性病变，有的酷似多发性硬化、脑炎。昏厥性抽搐（E错）病人以昏厥为主要症状。